女，30岁。被家人发现意识不清，呼吸浅慢1小时，近日曾和家人发生矛盾，平时健康。查体：T36.5℃，P60次/分，R10次/分，BP100/60mmHg。浅昏迷，瞳孔直径约1.5mm，口中有白色粉末状物，心肺听诊无异常。神经定位体征阴性，最关键确定诊断的措施是
A. 头颅CT检查
B. 镇静催眠药物含量测定
C. 血糖快速测定
D. 血肝肾功能测定
E. 心电图检查

正确答案：B。镇静催眠药物含量测定

解析：患者青年女性，被家人发现意识不清，呼吸浅慢1小时，查体：T36.5℃（正常36.3～37.2℃），P60次/分（正常60～100次/分），R10次/分（较慢，正常12～20次/分），BP100/60mmHg。浅昏迷，瞳孔直径约1.5mm（缩小，正常2～4mm），口中有白色粉末状物（提示可能服用药物中毒），余无明显异常。根据患者的病史、临床表现等，怀疑为大量服用镇静催眠药导致急性中毒，最关键确定诊断的措施是镇静催眠药物含量测定（B对）。